化合物引起过敏反应的特点中错误的是
A. 很小剂量进入机体即可致敏，再接触小量即可出现症状
B. 过敏原都是大分子化合物
C. 毒性反应不一定遵循剂量-反应关系
D. 反应表现不同于该化合物引起的一般毒性反应
E. 反应可速发，也可迟发

正确答案：B。过敏原都是大分子化合物